风湿性二尖瓣狭窄的特有体征是
A. 心尖部第一心音亢进
B. 心尖部舒张期隆隆样杂音
C. 心尖部收缩期吹风样杂音
D. 胸骨左缘第二肋间隙第二心音亢迸伴分裂
E. 开瓣音

正确答案：B。心尖部舒张期隆隆样杂音

解析：二尖瓣狭窄的听诊的特点：①局限于心尖区的低调、隆隆样、舒张中晚期递增型杂音（B对C错），左侧卧位时更明显，这是二尖瓣狭窄最重要而又特征性的体征。窦性心律时，由于舒张晚期心房收缩促使血流加速，杂音于此期加强；心房颤动时，舒张晚期杂音可不明显。②心尖区S₁亢进（A错），为本病听诊之第二个特征。③部分患者于心尖区内侧可闻及二尖瓣开放拍击音（开瓣音）（E错），提示瓣膜弹性及活动度尚好。胸骨左缘第二肋间隙第二心音亢迸伴分裂（D错）见于肺动脉高压的患者。